因含有雄黄，过量服用可致肝肾功能损害的中成药是
A. 牛黄上清丸
B. 牛黄降压丸
C. 牛黄解毒片
D. 冠心苏合丸
E. 桂枝茯苓丸

正确答案：C。牛黄解毒片

解析：本题考查的是含雄黄的中成药。因含有雄黄，过量服用可致肝肾功能损害的中成药是牛黄解毒片（C对）。含雄黄的中成药：牛黄解毒丸（片）、六神丸、喉症丸、安宫牛黄丸、牛黄清心丸、牛黄镇惊丸、牛黄抱龙丸、牛黄至宝丸、追风丸、牛黄醒消丸、紫金锭（散）、三品等。